男，35岁。体重75kg，因外伤性股骨颈骨折第2次入院手术。患者一般状况良好，BP125/80mmHg，Hb150g/L，血型鉴定为A型，抗体筛查发现存在多种红细胞抗体，交叉配血试验无法配上相容性血液。若需输血，应考虑的输血策略是
A. 输注其亲属的全血
B. 输注O型红细胞
C. 输注洗涤红细胞
D. 贮存式自身输血
E. 输注Rh阴性红细胞

正确答案：D。贮存式自身输血

解析：为了节约库存血，减少输血反应和疾病传播，国家鼓励自体输血。自体输血适应症包括①择期手术病人估计术中出血量较大需要输血者②有异体输血反应者③稀有血型或配血困难者④边远地区供血困难者。本患者股骨颈骨折需手术，预计术中出血量较大，其一般情况良好，但存在多种红细胞抗体，交叉配血试验无法配上相容性血液，符合自体输血一、三条，因此应采用贮存式自身输血（D对）。亲属全血（A错）、O型红细胞（B错）、Rh阴性红细胞（E错），血型都不一定相符，易发生溶血反应。洗涤红细胞（P25）主要适用于对白细胞凝集素有发热反应及肾功能不全不能耐受库存血高血钾者（C错）。